既能活血祛瘀，又能利尿消肿的药物是
A. 延胡索
B. 益母草
C. 鸡血藤
D. 姜黄
E. 三棱

正确答案：B。益母草

解析：益母草的功效是活血调经，利尿消肿，清热解毒（B对）。延胡索（A错）的功效是活血、行气、止痛。鸡血藤（C错）的功效是活血补血，调经止痛，舒筋活络。姜黄（D错）的功效是破血行气，通络止痛。三棱（E错）的功效是破血行气，消积止痛。